属沉降性的功效有
A. 泻下通便
B. 利水渗湿
C. 止咳平喘
D. 镇惊安神
E. 散寒开窍

正确答案：A、B、C、D。泻下通便；利水渗湿；止咳平喘；镇惊安神